关于肿瘤抗原的正确叙述是
A. TAA诱导的免疫应答具有典型的特异性和记忆性
B. TSA不能成为抗体识别和清除恶变细胞的抗原成分
C. TAA被宿主识别的过程具有MHC限制性
D. TSA抗原性较弱，难以刺激机体产生抗肿瘤免疫应答
E. TSA是肿瘤免疫诊断及治疗的有效靶点

正确答案：E。TSA是肿瘤免疫诊断及治疗的有效靶点